以人年为分母所计算的率为
A. 发病率
B. 发病密度
C. 病死率
D. 现患率
E. 死亡率

正确答案：B。发病密度

解析：本题考查发病密度的概念。发病密度（B对ACDE错）是指用人时为单位计算出来的带有瞬时频率性质的率，反映的是速率。理论上，发病密度的量值变化范围是从0到无穷大。发病密度（ID）＝观察期内的发病人数/观察总人时数。